酸蚀剂深龋洞洞壁进行处理前，应先行
A. 氧化锌丁香油酚粘固剂垫底
B. 磷酸锌粘固剂垫底
C. 玻璃离子粘固剂垫底
D. 氢氧化钙制剂垫底
E. 无需垫底

正确答案：D。氢氧化钙制剂垫底

解析：本题考查垫底。深龋洞时，首选氢氧化钙衬洞，以促进修复性牙本质形成，再使用玻璃离子粘固剂或其他垫底材料垫底，垫底后方可进行酸蚀（D对C错）。复合树脂充填不能用氧化锌丁香油酚粘固剂垫底（A错）。磷酸锌可释放游离酸刺激牙髓，不能用于直接垫底（B错）。深龋洞未垫底，酸蚀时可刺激牙髓，引起牙髓反应（E错）。